遗传性球形红细胞增多症
A. 红细胞脆性增加
B. 红细胞脆性降低
C. 红细胞酶缺陷
D. 血清铁蛋白减少
E. Coomb's试验

正确答案：A。红细胞脆性增加

解析：本题考查遗传性球形红细胞增多症的相关内容。遗传性球形红细胞增多症是红细胞先天性膜缺陷引起的溶血性贫血中最常见的一种类型。红细胞膜蛋白结构或功能有了缺陷，使红细胞变成了球形，由于表面积减少，变形能力减弱，而脆性随之增加（A对BCDE错），穿越脾脏毛细血管时就变得很困难，容易被脾脏破坏。